根据牙列缺损的Kennedy分类，6521|12346缺失者属于
A. 第三类第二亚类
B. 第三类第一亚类
C. 第二类第二亚类
D. 第四类第二亚类
E. 第四类

正确答案：A。第三类第二亚类

解析：本题考查Kennedy牙列缺损分类。6521|12346缺失是左侧后牙56缺失，缺隙两端均有天然牙存在，属于第三类；剩余部分牙齿缺失中，211234是连续缺失，即一个缺隙，6缺失是一个缺隙，属于第二亚类（A对B错）。第二类第二亚类（C错）指牙弓一侧后部牙缺失，远中无天然牙存在且还存在两个缺牙间隙。第四类（E错）指牙弓前部牙连续缺失并跨过中线，天然牙在缺隙远中，为单缺隙，无亚类，因为要以最后的缺牙间隙决定分类，如果第四类还存在别的缺牙间隙，则就不属于第四类了，所以没有第四类第二亚类（D错）这种说法。